工业废水常用的生物处理方法为
A. 活性污泥法
B. 混凝沉淀法
C. 离子交换法
D. 生物滤池法
E. 厌氧发酵法

正确答案：A。活性污泥法

解析：本题考查工业废水常用的生物处理方法。生物处理是利用微生物消耗水中有机物作为自身能量的来源，使废水中的有机污染物转化为稳定且无害的物质，可分为需氧处理和厌氧处理两类。需氧处理法是指在有氧条件下进行的处理，可分为活性污泥法和生物膜法。活性污泥法（A对BCDE错）是利用含有大量需氧微生物的活性污泥，在强力通气的条件下使污水净化的技术，是处理废水的常用方法。